《中华人民共和国药品管理法》规定批准开办药品批发企业并发给《药品经营许可证》的部门是
A. 国务院药品监督管理部门
B. 国务院卫生行政部门
C. 国务院劳动和社会保障部门
D. 省、自治区、直辖市人民政府药品监督管理部门
E. 省、自治区、直辖市人民政府卫生行政部门

正确答案：D。省、自治区、直辖市人民政府药品监督管理部门

解析：本题考查药品经营管理。开办药品批发企业（含药品零售连锁企业总部）的，应当向省级药品监督管理部门（D对）申请，经审批同意，依法获取《药品经营许可证》后，方可开展相应药品经营活动。